目前，适合我国流行病学的定义是
A. 研究疾病和健康状况在人群中的分布的学科
B. 预防医学的一门方法学
C. 研究常见病在人群中的分布及影响分布的因素以及预防对策的学科
D. 研究疾病与健康状况在人群中的分布和影响分布的因素以及预防对策的学科
E. 研究传染病在人群中的分布和影响分布的因素以及预防对策的学科

正确答案：D。研究疾病与健康状况在人群中的分布和影响分布的因素以及预防对策的学科